硝酸甘油的药理作用是
A. 减慢心率
B. 抑制心肌收缩力
C. 改善心肌缺血区的血液供应
D. 升高左心室舒张末压
E. 扩张外周血管，改善心肌血流动力学

正确答案：C、E。改善心肌缺血区的血液供应；扩张外周血管，改善心肌血流动力学

解析：本题考查硝酸甘油。硝酸甘油的药理作用是改善心肌缺血区的血液供应（C对）、扩张外周血管，改善心肌血流动力学（E对）。硝酸甘油可使全身血管扩张，降低左心室舒张末压（D错），反射性地引起心率加快（A错）、心肌收缩力增强（B错）。